肩胛骨的主要骨性标志是
A. 肩胛下角、肩胛冈、肩峰和喙突
B. 肩峰、喙突、冈上窝和肩胛切迹
C. 肩胛骨内侧角、肩峰、肩胛下窝
D. 外侧角、内侧缘、冈下窝和肩峰
E. 无

正确答案：A。肩胛下角、肩胛冈、肩峰和喙突

解析：肩胛冈、肩峰、肩胛下角、内侧缘及喙突均可在体表们到，为肩胛骨的主要骨性标志（A对）。